某人，因工作压力大，多年来经常反复出现心烦、心跳过速、胸部不适、出汗，经心电图、血压、血脂、心脏多普勒检查均正常。这个病人有可能为
A. 躯体疾病
B. 心身障碍
C. 心理症状
D. 神经衰弱
E. 精神疾病

正确答案：B。心身障碍

解析：心身关系分为三类：①心身反应，指精神性刺激引起的生理反应，当刺激除去，反应也就恢复：②心身障碍，指精神刺激引起的功能障碍，但没有器质性变化：③心身疾病，指精神刺激引起的器质性病变。本题患者心烦、心跳过速、胸部不适的躯体症状均是由工作压力大引起的，病因是明确的情绪因素，且没有器质性病变，属于典型的心身障碍（B对）。本题患者的躯体症状与情绪因素有明确的联系，不属于单纯的躯体疾病（A错）和心理症状（C错）。神经衰弱（D错）是由于长期处于紧张和压力下，出现精神易兴奋和脑力易疲乏现象，常伴有情绪烦恼、易激惹、睡眠障碍、肌肉紧张性疼痛等：这些症状不能归于脑、躯体疾病及其他精神疾病。精神疾病（E错）是指在各种生物学、心理学以及社会环境因素影响下，大脑功能失调，导致认知、情感、意志和行为等精神活动出现不同程度障碍为临床表现的疾病。